妊娠期龈炎的表现不正确的是
A. 可表现为一个或多个牙龈乳头呈瘤样肥大
B. 妊娠前存在不同程度的龈缘炎
C. 龈乳头扁圆形肥大，鲜红，易出血
D. 炎症在妊娠第6个月达高峰
E. 在分娩后，妊娠瘤可自行缩小

正确答案：D。炎症在妊娠第6个月达高峰

解析：妊娠期龈炎可表现为龈缘和牙龈乳头的炎症，也可表现为一个或多个牙龈乳头呈瘤样肥大。患者一般在妊娠前即有不同程度的慢性龈炎，从妊娠2～3个月后开始出现明显症状，至8个月时达到高峰，临床表现与血中黄体酮水平的升高相关联。分娩后约2个月时，龈炎可减轻至妊娠前水平。掌握“妊娠期龈炎”知识点。